下列牙龈指数（GI）的检查方法中，错误的是
A. 使用钝头牙周探针
B. 每颗牙的记分为4个牙面记分的平均值
C. 必须检查全口牙
D. 须检查每颗牙周围的牙龈
E. 需结合视诊和探诊

正确答案：C。必须检查全口牙

解析：牙龈指数（GI）检查方法：检查使用钝头牙周探针，结合视诊和探诊。检查全口或几颗选定的牙。须检查每颗牙周围的牙龈，将其周围牙龈分为近中唇（颊）乳头、正中唇（颊）缘、远中唇（颊）乳头和舌侧龈缘。每颗牙的记分为4个牙面记分的平均值，每人记分为全部受检牙记分的平均值。掌握“牙周病流行病学及分级预防”知识点。